高血压合并甲亢首选降压药物
A. 血管紧张素转化酶抑制剂
B. 钙通道阻滞剂
C. 利尿剂
D. a受体拮抗剂
E. β受体拮抗剂

正确答案：E。β受体拮抗剂

解析：高血压合并甲亢一般首选β受体拮抗剂，因为其不仅可以阻断甲状腺激素对心脏的兴奋作用；还可以阻断外周组织T4向T3的转化，在ATD治疗初期使用，可较快控制甲亢的临床症状（E对）。血管紧张素转化酶抑制剂（ACEI）（A错）具有改善胰岛素抵抗和减少尿蛋白作用，对肥胖、糖尿病和心脏、肾脏靶器官受损的高血压病人具有较好的疗效，特别适用于伴有心力衰竭、心肌梗死、房颤至蛋白尿、糖耐量减退或糖尿病肾病的高血压病人。钙通道阻滞剂（B错）一般用于老年人单纯收缩期高血压合并冠心病、糖尿病、外周血管病。利尿剂（C错）一般用于单纯性收缩期高血压、老年人高血压等。a受体拮抗剂（D错）一般用于血管痉挛性疾病、嗜铬细胞瘤等。